患者，女，24岁，已婚。产后4周恶露过期不止，量多、色淡红、质稀，小腹空坠，面色晄白，舌淡，脉缓弱。治疗应首选
A. 归脾汤
B. 补中益气汤
C. 圣愈汤
D. 人参养营汤
E. 参附汤

正确答案：B。补中益气汤

解析：患者产后恶露四周不止，量多，色淡红，质稀，是因为气虚冲任子宫失摄，气虚阳气不振，血失温煦；气虚清阳不升则面色晄白，气虚下陷则小腹空坠，故选择补中益气汤以补气摄血固冲（B对）。归脾汤功效是益气补血，健脾养心，用于心脾气血两虚证，常见心悸怔仲，失眠健忘，盗汗，体倦食少，面色萎黄等心脾两虚之象；脾不统血证常见妇女崩漏，月经超前，量多色淡，或淋漓不止，舌淡，脉细弱之象（A错）。圣愈汤功效补气，补血，摄血，用于气血虚弱，气不摄血证，多见月经先期而至，量多色淡，四肢乏力，体倦神疲（C错）。人参养荣汤功效益气补血，养血安神。用于心脾气血两虚证，常见倦怠乏力，食少无味，惊悸健忘，夜寐不安，虚热自汗，咽干唇燥，形体消瘦等症状（D错）。参附汤功效益气回阳固脱。用于阳气暴脱证，常见四肢厥逆，冷汗淋漓，呼吸微弱，脉微欲绝（E错）。